可能引起体位性低血压的药物有
A. 甲基多巴
B. 硝普钠
C. 麻黄碱
D. 布洛芬
E. 哌唑嗪

正确答案：A、B、E。甲基多巴；硝普钠；哌唑嗪

解析：本题考查可引起体位性低血压的药物。可能引起体位性低血压的药物有甲基多巴（A对）、硝普钠（B对）、哌唑嗪（E对）。常见的能够引起体位性低血压的药物，主要为α受体阻断剂，其常见的药物有酚妥拉明、哌唑嗪、特拉唑嗪等。除此之外，还有一些硝酸酯类的药物，也容易引起体位性低血压，比如硝酸甘油、硝普钠和利血平等。哌唑嗪首次给药可致严重的体位性低血压、晕厥、心悸等，称“首剂现象”，多见于首次用药90分钟内，发生率高达50%。麻黄碱（C错）具有升压作用，布洛芬（D错）为抗炎药，二者均不会引起体位性低血压。